溶组织内阿米巴的致病型是
A. 包囊
B. 小滋养体
C. 大滋养体
D. 裂殖体
E. 配子体

正确答案：C。大滋养体

解析：滋养体为溶组织阿米巴的致病形态，寄生在组织中，分为大、小滋养体。大滋养体有侵袭力（C对）。小滋养体（P272）（B错）寄生在肠腔内，以细菌及真菌为食，当宿主抵抗力降低时，便侵入肠壁组织转变为大滋养体而致病为溶组织阿米巴的致病型。裂殖体（D错）是某些原生动物无性生殖过程中的产物，核分裂为若干个，而细胞质不分裂。配子体（E错）是某些原生动物裂殖子放出后，经过几代裂殖体增殖的某些裂殖子进入其侵袭的细胞组织后形成，可进行有性生殖。